何者不正确
A. 由消化管道和消化腺组成
B. 通常称口腔到咽的一段为上消化道
C. 通常称口腔到十二指肠为上消化道
D. 肝、胰为消化腺
E. 结肠和直肠为下消化道的一部分

正确答案：B。通常称口腔到咽的一段为上消化道

解析：消化系统由消化管和消化腺组成(A对)，通常将口腔到十二指肠成为上消化道(C对B错，为本题正确答案)，肝、胰为大消化腺(D对)，结肠和直肠在空肠以下，属于下消化道(E对)。